依照《处方管理办法》的规定，调剂处方必须做到“四查十对”，其“四查”是指
A. 查剂量、查用法、查重复用药、査配伍禁忌
B. 查姓名、查药品、査剂量用法、査给药途径
C. 查处方、査药的性状、査给药途径、查用药失误
D. 查处方、查药品、查配伍禁忌、查用药合理性
E. 查给药途径、査重复给药、査用药失误、査药品价格

正确答案：D。查处方、查药品、查配伍禁忌、查用药合理性

解析：本题考查的是“四查十对”原则。依照《处方管理办法》的规定，调剂处方必须做到“四查十对”，其“四查”是指查处方、查药品、查配伍禁忌、查用药合理性（D对）。“四查十对”原则：药师调剂处方时必须做到“四查十对”：查处方，对科别、姓名、年龄；查药品，对药名、剂型、规格、数量；查配伍禁忌，对药品性状、用法用量；查用药合理性，对临床诊断。